急性肾小球肾炎肺脾不足，水湿停滞证的治法是
A. 健脾补肾
B. 健脾补肺，利水消肿
C. 健脾补肾，清热通淋
D. 滋阴益肾，清热通淋
E. 益气扶正，利水消肿

正确答案：B。健脾补肺，利水消肿

解析：急性肾小球肾炎肺脾不足，当补肺健脾；水湿停滞应利水，故肺脾不足，水湿停滞证的治法是健脾补肺，利水消肿（B对）。健脾补肾是脾肾两虚证的治法（A错）。健脾补肾，清热通淋是脾肾亏虚，湿热屡犯证的治法（C错）。滋阴益肾，清热通淋是肾阴不足，水湿停滞的治法（D错）。益气扶正，利水消肿是肺肾不足，水湿停滞的治法（E错）。